国家对执业药师实行注册制度，下列不符合执业药师注册管理规定的是
A. 执业药师的执业范围包括药品生产、药品经营、药品使用以及其他需要提供药学服务的单位
B. 取得执业药师职业资格证书（药学类）和执业药师职业资格证书（中药学类）的“双证”人员，可以同时在两个执业单位注册执业
C. 执业药师的执业类别包括药学类、中药学类、药学与中药学类
D. 取得执业药师职业资格证书的人员，申请并取得《执业药师注册证》后，方可以执业药师身份执业

正确答案：B。取得执业药师职业资格证书（药学类）和执业药师职业资格证书（中药学类）的“双证”人员，可以同时在两个执业单位注册执业

解析：本题考查的是执业药师执业活动的监督管理。执业药师同时在两个执业单位注册执业属于违法违规行为（B错，为本题正确答案）。国家药品监督管理局与人力资源社会保障部按照职责分工对执业药师职业资格制度实施和执业药师执业行为进行监督和检查。负责药品监督管理的部门按照有关规定对执业药师配备情况及其执业活动实施监督检查，包括监督检查以不正当手段取得《执业药师职业资格证书》，以欺骗、贿赂等不正当手段取得《执业药师注册证》，未按规定配备执业药师，挂靠《执业药师注册证》（执业药师“挂证”)单位买卖、租借《执业药师注册证》等违法违规行为。同时将建立执业药师个人诚信记录，对其执业活动实行信用管理。执业药师的违法违规行为、接受表彰奖励及处分等，作为个人诚信信息由负责药品监督管理的部门及时记入全国执业药师注册管理信息系统；执业单位和执业药师应当对负责药品监督管理的部门的监督检查予以协助、配合，不得拒绝、阻挠。执业药师应当按照执业类别、执业单位、执业范围进行注册和执业。执业类别为药学类、中药学类、药学与中药学类（C对）；执业范围为药品生产、药品经营、药品使用以及其他需要提供药学服务的单位（A对）。机关、院校、科研单位、药品检验机构不属于规定的注册执业单位。取得执业药师职业资格的药学专业技术人员，经执业单位考核同意，通过全国执业药师注册管理信息系统向所在地注册管理机构申请注册。经批准注册者，由执业药师注册管理机构核发国家药监局统一样式的《执业药师注册证》，方可从事相应的执业活动（D对）。未经注册者，不得以执业药师身份执业。